记录发病的时间、地点、起病缓急等情况的属于
A. 发病情况
B. 伴随症状
C. 发病以来诊治经过及结果
D. 发病以来一般情况
E. 主要症状特点及其发展变化情况

正确答案：A。发病情况

解析：发病情况：记录发病的时间、地点、起病缓急、前驱症状、可能的原因或诱因。掌握“口外病史记录”知识点。